看近物时，下列结构的变化，何者正确
A. 睫状肌收缩
B. 睫状体突向后外
C. 睫状小带紧张
D. 晶状体囊对晶状体的压迫增强
E. 晶状体变薄，屈光度减小

正确答案：A。睫状肌收缩

解析：看近物时，睫状肌收缩（A对），使睫状体内伸，而非凸向后外（B错）；睫状小带变松弛，而非紧张（C错）；晶状体借助于晶状体囊及其本身的弹性而变凸，即晶状体囊对晶状体的压迫减弱，而非增强（D错）；晶状体增厚，屈光度增大，而非晶状体变薄，屈光度减小（E错）。